补骨脂中的成分主要是
A. 简单香豆素
B. 呋喃香豆素
C. 新木脂素
D. 联苯环辛烯型木脂素
E. 简单木脂素型木脂素

正确答案：B。呋喃香豆素

解析：本题考查的是补骨脂的化学成分。补骨脂中的成分主要是呋喃香豆素（B对）。补骨脂含有多种香豆素类成分，包括补骨脂内酯（补骨脂素）、异补骨脂内酯（异补骨脂素）和补骨脂次素等。《中国药典》采用高效液相色谱法测定药材中补骨脂素和异补骨脂素含量，两者总含量不得少于0.70%。呋喃香豆素类：呋喃香豆素结构中的呋喃环往往是由香豆素母核上所存在的异戊烯基与其邻位的酚羟基环合而成的，成环后有时伴随着失去3个碳原子（丙酮）的变化。1.6，7-呋喃骈香豆素型（线型）：此型以补骨脂内酯为代表，又称补骨脂内酯型。例如香柑内酯、花椒毒内酯、欧前胡内酯、紫花前胡内酯等。2.7，8-呋喃骈香豆素型（角型）：此型以白芷内酯为代表。白芷内酯又名异补骨脂内酯，故又称异补骨脂内酯型。如异香柑内酯、茴芹内酯。简单香豆素（A错）类：这类是指仅在苯环有取代基的香豆素类。如伞形花内酯、茵芋苷。联苯环辛烯型木脂素（D错）为五味子中的主要成分。五味子中含木脂素较多，约为5%，近年来从其果实中分得了一系列联苯环辛烯型木脂素。《中国药典》采用高效液相色谱法测定药材中五味子醇甲的含量，要求不得少于0.40%。新木脂素（C错）与简单木脂素（E错），2022年考试指南未明确说明。